通过细胞膜的主动变形将药物摄入细胞内或从细胞内释放到细胞外的过程是
A. 肠肝循环
B. 反向吸收
C. 清除率
D. 膜动转运
E. 平均滞留时间

正确答案：D。膜动转运

解析：本题考查药物的转运方式。膜动转运（D对）是通过膜的主动变形来摄取或排出物质；肠肝循环（A错）是药物经过肝脏代谢后,它的代谢物或者是没有被代谢的原型,会经过胆汁排入十二指肠,然后再由十二指肠到小肠,在肠道中重新被吸收进入血液循环的现象；清除率（C错）是反映药物从血浆中被除去的能力；平均滞留时间（E错）是药物分子在体内停留的平均时间。